设定和实施行政许可的信赖保护原则，是指
A. 行政机关应当公开、公平、公正保护，行政相对人的合法权益
B. 行政机关应当依照法定的权限、范围、条件和程序，设定和实施行政许可
C. 公民、法人或者其他组织依法取得的行政许可受法律保护，行政机关不得擅自改变已经生效的行政许可
D. 公民、法人或其他组织应当诚实守信，维护法律权威

正确答案：C。公民、法人或者其他组织依法取得的行政许可受法律保护，行政机关不得擅自改变已经生效的行政许可

解析：本题考查的是设定和实施行政许可的原则。设定和实施行政许可的信赖保护原则，是指公民、法人或者其他组织依法取得的行政许可受法律保护，行政机关不得擅自改变已经生效的行政许可（C对）。设定和实施行政许可的原则：1.法定原则：设定和实施行政许可，应当依照法定的权限、范围、条件和程序（B错）。2.公开、公平、公正原则：设定和实施行政许可，应当公开、公平、公正，维护行政相对人的合法权益（A错）。3.便民和效率原则：实施行政许可，应当便民，提高办事效率，提供优质服务。4.信赖保护原则：公民、法人或者其他组织依法取得的行政许可受法律保护，行政机关不得擅自改变已经生效的行政许可。行政许可所依据的法律、法规、规章修改或者废止，或者准予行政许可所依据的客观情况发生重大变化的，为了公共利益的需要，行政机关可以依法变更或者撤回已经生效的行政许可。由此给公民、法人或者其他组织造成财产损失的，行政机关应当依法给予补偿。